女，38岁。进行性贫血、消瘦、乏力半年，有时右腹隐痛，无腹泻。查体：右中腹部扪及肿块，肠音活跃。如果需要手术治疗，针对该手术术前准备最重要的是
A. 纠正营养不良
B. 肠道准备
C. 心肺功能检查
D. 肝肾功能检查
E. 心理准备

正确答案：B。肠道准备

解析：患者消瘦、乏力，贫血，右中腹肿块（右侧结肠癌的典型症状），诊断为结肠癌。结肠癌手术属于消化道手术，因此患者术前准备中最重要的是肠道准备（B对），可以有效预防术后并发症。纠正营养不良（A错）、心肺功能检查（C错）、肝肾功能检查（D错）、心理准备（E错）为所有手术患者的一般术前准备，不是最重要准备。